女，45岁。性交后出血半年。妇科检查：宫颈Ⅰ度糜烂状。宫颈细胞学检查结果为低度鳞状上皮内病变（LSIL）。为明确诊断，下一步应首选的处理是
A. 宫颈冷刀锥切
B. 宫颈电热圈切除术
C. 阴道镜下活检
D. 宫颈管搔刮
E. HPV-DNA检测

正确答案：C。阴道镜下活检

解析：患者为中老年女性，出现接触性出血（宫颈癌常表现为接触性出血，即性生活或妇科检查后阴道流血），宫颈细胞学检查结果为低度鳞状上皮内瘤变（LSIL）。为明确诊断，下一步应首选的处理是阴道镜下活检（C对）。宫颈冷刀锥切（P307）（A错）、宫颈电热圈切除术（P307）（B错）即子宫颈环形电切除术属于子宫颈锥切术，适用于子宫颈细胞学检查多次阳性而子宫颈活检阴性者，或子宫颈活检为CINⅡ或CINⅢ需确诊者，或可疑微小浸润癌需了解病灶的浸润深度和宽度等。宫颈管搔刮（D错）为子宫内膜癌的诊断依据。HPV-DNA检测（P409）（E错）用于子宫颈癌及其癌前病变的筛查，不是确诊依据。